赭曲霉毒素主要污染的食品是
A. 玉米和花生
B. 大豆和可可豆
C. 小麦和玉米
D. 大米
E. 山楂汁和苹果汁

正确答案：B。大豆和可可豆

解析：本题考查赭曲霉毒素主要污染的食品。赭曲霉毒素主要污染玉米、大豆、可可豆（B对ACDE错）、大麦、柠檬类水果、腌制的火腿、花生、咖啡豆等。